直肠指检能够发现的直肠癌约占总数的
A. 40％～49％
B. 50％～59％
C. 60％～69％
D. 70％～79％
E. 80％～89％

正确答案：D。70％～79％